婚前医学检查的主要疾病不包括
A. 严重遗传性疾病
B. 指定传染病
C. 重型精神病
D. 重要脏器疾病
E. 过敏性疾患

正确答案：E。过敏性疾患

解析：本题考查婚前医学检查的主要疾病。过敏性疾病（E错，为本题正确答案）不属于婚前医学检查的主要疾病。婚前医学检查的主要疾病包括：严重遗传性疾病（A对）、指定传染病（B对）、有关重型精神病（C对）、重要脏器疾病（D对）和生殖器异常。